用青霉素治疗下列疾病的过程中，首剂肌注后可出现赫氏反应的是
A. 流脑
B. 猩红热
C. 钩体病
D. 白喉
E. 败血症

正确答案：C。钩体病

解析：赫氏反应是指在应用应用青霉素G治疗梅毒、钩端螺旋体（C对）、雅司、鼠咬热或炭疽等感染时，可有症状加剧现象，表现为全身不适、寒战、发热、咽痛、肌痛、心跳加快等症状，此反应可能是大量病原体被杀死后释放的物质所引起的。在治疗流脑（A错）、猩红热（B错）、白喉（D错）和败血症（E错）时均不会出现赫氏反应。